根据《关于发布化学药品注册分类改革工作方案的公告》的药品注册分类，境内申请人仿制境外上市但境内未上市原研药品的药品注册类别是
A. 3类
B. 1类
C. 4类
D. 2类

正确答案：A。3类

解析：本题考查药品注册类别。化学药品新注册分类共分为5个类别。1类（B错）：境内外均未上市的创新药。指含有新的结构明确的、具有药理作用的化合物，且具有临床价值的药品。2类（D错）：境内外均未上市的改良型新药。指在已知活性成分的基础上，对其结构、剂型、处方工艺、给药途径、适应症等进行优化，且具有明显临床优势的药品。3类（A对）：境内申请人仿制境外上市但境内未上市原研药品的药品。该类药品应与原研药品的质量和疗效一致。原研药品指境内外首个获准上市，且具有完整和充分的安全性、有效性数据作为上市依据的药品。4类（C错）：境内申请人仿制已在境内上市原研药品的药品。该类药品应与原研药品的质量和疗效一致。5类：境外上市的药品申请在境内上市，分为原研药品和非原研药品两类。对应原化学药品注册分类中的进口药品类别。